关于药代动力学参数说法错误的是
A. 某药的生物半衰期为0.5小时，表明该药从体内消除的速率较快
B. 地高辛在人体的表观分布容积约500L，表明药物广泛分布于组织中
C. 表观分布容积不代表真实的生理容积
D. 某药物经肝肾两种途径从体内消除，该药物总清除率等于肝清除率与肾清除率之和
E. 米氏常数是指血药浓度降低一半时所对应的药物消除速率

正确答案：E。米氏常数是指血药浓度降低一半时所对应的药物消除速率

解析：本题考查药动学参数。米氏常数Km是指药物消除速度为Vm一半时的血药浓度（E错，为本题正确答案）。